男性，40岁，胸痛、反酸、烧心、嗳气2个月，胃镜检查食管粘膜未见明显异常，最有助于明确诊断的检查是
A. 上消化道气钡双重造影
B. C¹³尿素呼气试验
C. 24小时胃食管pH监测
D. 腹部B超
E. 24小时心电监测

正确答案：C。24小时胃食管pH监测

解析：患者为中年男性，有胸痛、反酸、烧心、嗳气病史，查胃镜胃粘膜未见明显异常，此时应予24小时胃食管PH监测（C对）明确有无酸反流的证据。上消化道气钡双重造影（A错）用于胃癌的诊断，对胃食管反流病的诊断价值不大。C13尿素呼气试验（B错）用于幽门螺杆菌的监测，不用于胃食管反流病的诊断。腹部B超（D错）用于诊断肝、胆、胰、脾等脏器的损伤，不用于胃食管反流病的诊断。24小时心电监测（E错）用于危重病人的监护，不用于胃食管反流病的诊断。